确诊流脑的依据是
A. 流行季节
B. 突然发病高热头痛呕吐
C. 脑膜刺激征阳性
D. 皮肤瘀点检菌阳性
E. 脑脊液为典型化脓性脑膜炎改变

正确答案：D。皮肤瘀点检菌阳性

解析：皮肤瘀点处的组织液或离心沉淀后的脑脊液做涂片染色，阳性率为 60%-80%。瘀点涂片简便易行，应用抗生素早期亦可获得阳性结果，是流脑早期诊断的重要方法（D对）。